分布至胃底的动脉是
A. 胃短动脉
B. 胃网膜左动脉
C. 胃左动脉
D. 胃右动脉
E. 胃网膜右动脉

正确答案：A。胃短动脉

解析：胃短动脉（A对）经胃脾韧带分布至胃底，有3-5条分支。